患者，女性，50岁。左下肢有蚯蚓状静脉迂曲，站立时明显，平卧时减轻，应首先诊断考虑为
A. 浅静脉炎
B. 动脉硬化性闭塞症
C. 血栓闭塞性脉管炎
D. 下肢深静脉血栓形成
E. 下肢静脉曲张

正确答案：E。下肢静脉曲张

解析：患者女性，50岁，左下肢有蚯蚓状静脉迂曲，站立时明显，平卧时减轻，诊断为下肢静脉曲张（E对）。浅静脉炎患肢局部红肿，疼痛，行走时加重，可触及痛性索状硬条或串珠样结节（A错）。动脉硬化性闭塞症早期的症状主要为肢体发凉、间歇性跛行，可有肢体麻木，沉重无力，酸痛，刺痛及烧灼感、继而出现静息痛皮肤温度下降，皮肤颜色变化，肢体失养，动脉搏动减弱或消失（B错）。血栓闭塞性脉管炎诊断要点：①年龄45岁以下青壮年男性，多有吸烟史。②病程长，早期患肢发凉、怕冷、麻木、疼痛、间歇性跛行、静息痛或发生溃疡及坏疽。③患肢皮肤苍白、潮红、紫红或青紫，皮温低。④游走性浅静脉炎表现。⑤患肢足背动脉、胫后动脉减弱或消失，甚至膈动脉、股动脉搏动减弱或消失。侵犯上肢者，尺动脉、桡动脉搏动减弱或消失。⑥除外闭塞性动脉硬化症、大动脉炎等疾病。⑦实验室及其他检查支持（C错）。下肢深静脉血栓形成，诊断要点：①发病急骤，患肢胀痛，股三角区或小腿有明显压痛，Homans征可呈阳性。②患肢广泛性肿胀，可有广泛性浅静脉怒张。③患肢皮肤可呈暗红色、温度升高。④慢性期具有下肢回流障碍和静脉逆流征，即活动后肢体凹陷性肿胀，浅静脉怒张或曲张，出现营养障碍表现、色素沉着、淤积性皮炎、溃疡等。⑤多普勒肢体血流检查或静脉造影显现静脉回流障碍及静脉血栓。⑥排除动脉栓塞、淋巴管炎、盆腔肿瘤、淋巴水肿、肾病性、心源性水肿等疾病（D错）。